碘缺乏病可对人体产生的多种危害之中不包括
A. 胎儿早产、死产
B. 单纯性聋哑
C. 视野缩小
D. 甲状腺肿
E. 克汀病

正确答案：C。视野缩小

解析：本题考查碘缺乏病对人体产生的危害。碘缺乏病是指从胚胎发育至成人期由于碘摄入量不足而引起的一系列病症。它对人体产生的危害包括：胎儿早产、死产（A对）、单纯性聋哑（B对）、地方性甲状腺肿（D对）、地方性克汀病（E对）等。碘缺乏病不会造成人体视野缩小（C错，为本题正确答案）。